根据《中华人民共和国刑法》，生产、销售假药，致人死亡的应
A. 处以三年以下有期徒刑，并处罚金
B. 处以三年以上十年以下有期徒刑
C. 处以三年以上十年以下有期徒刑，并处罚金
D. 处以十年以上有期徒刑或者无期徒刑罚金或者没收财产
E. 处以十年以上有期徒刑、无期徒刑或者死刑，并处罚金或者没收财产

正确答案：E。处以十年以上有期徒刑、无期徒刑或者死刑，并处罚金或者没收财产

解析：本题考查生产、销售、提供假药的刑事责任。根据《中华人民共和国刑法》，生产、销售假药，致人死亡的应处以十年以上有期徒刑、无期徒刑或者死刑，并处罚金或者没收财产（E对）。生产、销售、提供假药的刑事责任：根据《刑法》第一百四十一条规定，生产、销售假药的，处三年以下有期徒刑或者拘役，并处罚金（A错）；对人体健康造成严重危害或者有其他严重情节的，处三年以上十年以下有期徒刑，并处罚金；致人死亡或者有其他特别严重情节的，处十年以上有期徒刑、无期徒刑或者死刑，并处罚金或者没收财产。生产、销售、使用劣药的刑事责任：根据《刑法》第一百四十二条规定，生产、销售劣药，对人体健康造成严重危害的，处三年以上十年以下有期徒刑，并处罚金（C错）；后果特别严重的，处十年以上有期徒刑或者无期徒刑，并处罚金或者没收财产（D错）。